经典途径的激活物质是
A. IgG或IgM
B. C3b
C. MBL
D. CR
E. 酵母多糖类

正确答案：A。IgG或IgM

解析：IgG或IgM抗原抗体复合物是经典途径的主要激活物。掌握“补体的概念，激活途径及调节”知识点。